男性，45岁。无痛性肉眼血尿3个月，IVP显示左肾盂内有充盈缺损，膀胱镜见左侧输尿管口喷血，应考虑
A. 肾结核
B. 肾癌
C. 阴性结石
D. 肾盂癌
E. 肾炎

正确答案：D。肾盂癌

解析：中年男性患者，无痛性肉眼血尿3个月（提示可能有泌尿系肿瘤），IVP检查显示左肾盂内有充盈缺损（提示肾盂内占位性病变），膀胱镜检查见左侧输尿管口喷血（上尿路肿瘤的表现），结合患者临床表现和相关检查，应考虑左肾盂癌（D对）。肾结核（A错）典型表现为膀胱刺激症状伴终末血尿，可有低热、盗汗等结核中毒症状。肾癌（B错）主要表现为无痛肉眼血尿、腰痛和腹部肿块。肾结石（C错）位于肾盂时可无明显临床症状，活动后出现上腹或腰部钝痛。肾炎（E错）主要指肾小球肾炎，多继发于链球菌感染之后，主要表现为血尿、蛋白尿、水肿和高血压。